我国现行的主体性的车间空气中有害物质职业接触限值是
A. 最高容许浓度
B. 容许接触限值
C. 时间加权平均容许浓度
D. 阈限值
E. 短时间接触容许浓度

正确答案：C。时间加权平均容许浓度